甲状腺功能亢进患者服用丙硫氧嘧啶，可引起的典型药源性疾病是
A. 粒细胞减少症
B. 消化性溃疡
C. 慢性肾衰竭
D. 溶血性贫血
E. 呼吸抑制

正确答案：A。粒细胞减少症

解析：本题考查药源性疾病。甲状腺功能亢进患者服用丙硫氧嘧啶，可引起的典型药源性疾病是粒细胞减少症（A对）。布洛芬、吲哚美辛、阿司匹林等可引起消化性溃疡（B错）。含有马兜铃酸的中药可引起肾损害，表现为急、慢性肾衰竭（C错）。苯妥英钠、吲哚美辛、奎尼丁、利福平等引起溶血性贫血（D错）。快速静注克林霉素可引起呼吸抑制（E错）。